RR
A. 是暴露比之于未暴露情况下增加超额疾病的数量
B. 是非暴露组与暴露组发病或死亡危险之差的绝对值
C. 是非暴露组发病或死亡的危险为暴露组的多少倍
D. 比特异危险度更具有病因学意义
E. 比特异危险度更具有疾病预防和公共卫生意义

正确答案：D。比特异危险度更具有病因学意义

解析：本题考查相对危险度和归因危险度的比较。RR与AR都是表示关联强度的重要指标。RR说明暴露者发生相应疾病的危险是非暴露者的多少倍；AR则是指暴露人群与非暴露人群比较，所增加的疾病发生数量，如果暴露因素消除，就可减少这个数量的疾病发生。前者具有病因学的意义（D对ABCE错），后者更具有疾病预防和公共卫生学上的意义。